以下关于乳前牙的临床应用解剖说法错误的是
A. 体积小，牙冠短小，乳白色
B. 颈嵴突出，冠根分明
C. 宽冠窄根是乳前牙的特点
D. 上颌乳中切牙的解剖标志是宽冠宽根
E. 上颌乳尖牙的牙尖偏向远中，与恒尖牙相同

正确答案：E。上颌乳尖牙的牙尖偏向远中，与恒尖牙相同

解析：本题考查乳恒牙鉴别及牙体形态的生理意义。与恒牙比较，乳牙具有下列特点：1.乳牙呈乳白色，体积较同名恒牙小，牙冠短而宽（A对）。2.乳牙颈部缩窄，颈嵴突出，牙根明显缩小，冠根分明（B对）。3. 宽冠窄根是乳前牙的特点（C对），但上颌乳中切牙为宽冠宽根（D对）。4.上颌乳尖牙的近中牙尖嵴长于远中牙尖嵴，是乳尖牙和恒尖牙中牙尖唯一偏远中者（E错，为本题正确答案）。5. 乳磨牙体积依次递增，下颌第二乳磨牙近中颊尖、远中颊尖和远中尖等大。乳磨牙（牙合）方聚合度大，（牙合）面缩窄， 尖、嵴、窝、沟不清晰。6. 除上颌乳中切牙牙根扁宽外，其余乳前牙牙根细长，根尖均偏唇侧。乳磨牙根干特短，分叉度特大，上颌乳磨牙为三根， 即近、远中颊根和舌根，下颌乳磨牙为二根，即近中根和远中根。